阻止胞苷酸转化为脱氧胞苷酸的药物是
A. 氟尿嘧啶
B. 阿糖胞苷
C. 羟基脲
D. 甲氨蝶呤
E. 巯嘌呤

正确答案：C。羟基脲

解析：本题考查干扰核酸生物合成的药物。阻止胞苷酸转化为脱氧胞苷酸的药物是羟基脲（C对）。羟基脲为核苷酸还原酶抑制剂，通过破坏组成该酶活性中心的酪氨酰游离基而起到抑制该酶的作用，使胞苷酸转化为脱氧胞苷酸受阻，从而抑制DNA合成。氟尿嘧啶（A错）为胸苷酸合成酶抑制剂。阿糖胞苷（B错）为DNA多聚酶抑制剂。甲氨蝶呤（D错）为二氢叶酸还原酶抑制剂。巯嘌呤（E错）为嘌呤核苷酸互变抑制剂。